医疗机构必须配备药学技术人员，配备的这类人员应是依法经过
A. 学历认定
B. 资历认定
C. 资格认定
D. 资质认定
E. 执业认定

正确答案：C。资格认定